肝胰壶腹
A. 在十二指肠上部壁内
B. 由胆总管和胰管汇合而成
C. 在十二指肠水平部壁内
D. 为胆总管末端膨大而成
E. 为胰管末端膨大而成

正确答案：B。由胆总管和胰管汇合而成

解析：肝胰壶腹在十二指肠降部(AC错)中份后内侧壁上，为胆总管与胰管汇合后膨大而成(B对DE错)。